覆盖在囊胚上面的蜕膜为
A. 底蜕膜
B. 包蜕膜
C. 真蜕膜
D. 叶状绒毛膜
E. 滑泽绒毛膜

正确答案：B。包蜕膜

解析：受精卵植入分泌期的子宫内膜后，子宫内膜增厚称蜕膜。按蜕膜与孕卵及子宫壁的关系，将其分为底蜕膜、包蜕膜、真蜕膜3部分；孕卵着床处的蜕膜，位于孕卵与子宫肌壁之间的为底蜕膜，覆盖在孕卵上的为包蜕膜，除底蜕膜与包蜕膜之外，覆盖在子宫腔表面的称为真蜕膜。随着胎儿发育，包蜕膜和真蜕膜贴近融合，形成胎膜的一部分，底蜕膜形成胎盘的胎儿部分（B对AC错）；囊胚着床后，其外层为滋养层，增殖分化为原始绒毛，与底蜕膜相接触的发育成叶状绒毛膜，与包蜕膜接触的退化为滑泽绒毛膜（DE错）。